固体分散体最适宜的制备方法是
A. 共沉淀法
B. 交联剂固化法
C. 胶束聚合法
D. 注入法
E. 重结晶法

正确答案：A。共沉淀法

解析：本题考查固体分散体。固体分散体最适宜的制备方法是共沉淀法（A对）。交联剂固化法（B错）为制备微球的方法；胶束聚合法（C错）为制备毫微粒制剂的方法；注入法（D错）为制备脂质体的方法；重结晶法（E错）为制备β-环糊精包含物的方法。